小学生合理膳食的安排最好是
A. 早餐和午餐应为富含蛋白质和脂肪食物
B. 午餐应为富含蛋白质和脂肪食物
C. 早餐应为富含蛋白质和脂肪食物
D. 午餐和晚餐应为富含蛋白质和脂肪食物
E. 晚餐应为富含蛋白质和脂肪食物

正确答案：A。早餐和午餐应为富含蛋白质和脂肪食物

解析：本题考查小学生合理膳食的安排。一般吃完晚餐后不久就要就寝休息了，此时胃的消化能力下降，蛋白质和脂肪不容易消化和吸收，因此一般将富含蛋白质和脂肪食物作为早餐和午餐（A对BCDE错）。